分布至腹腔内成对脏器的动脉是
A. 肠系膜下动脉
B. 肠系膜上动脉
C. 肾动脉
D. 腹腔干
E. 膈下动脉

正确答案：C。肾动脉

解析：肠系膜下动脉（A错）、肠系膜上动脉（B错）、腹腔干（D错）为不成对的脏支。肾动脉（C对）为分布至腹腔内成对脏器的动脉。膈下动脉（E错）分布于膈肌及腹壁。